国家建立突发公共卫生事件的信息发布制度。负责向社会发布突发公共卫生事件信息的部门是
A. 国务院卫生行政主管部门
B. 外交部
C. 信息产业部
D. 国务院
E. 中国疾病预防控制中心

正确答案：A。国务院卫生行政主管部门

解析：本题考查突发公共卫生事件信息发布。国家建立突发公共卫生事件的信息发布制度。负责向社会发布突发公共卫生事件信息的部门是国务院卫生行政主管部门（A对）。国家建立突发公共卫生事件的信息发布制度。国务院卫生行政部门负责向社会发布突发公共卫生事件的信息。必要时，可以授权省、自治区、直辖市人民政府卫生行政部门向社会发布本行政区域内突发公共卫生事件的信息。信息发布应当及时、准确、全面。